年轻恒牙露髓应尽量采用
A. 根充术
B. 干髓治疗
C. 根尖诱导成形术
D. 保髓治疗
E. 干髓术

正确答案：D。保髓治疗

解析：本题考查年轻恒牙的特点。年轻恒牙露髓应尽量采用保髓治疗（D对）。由于年轻恒牙尚处于不断萌出中，故临床牙冠的高度显得低，牙根尚未完全形成，髓腔整体宽大，根管壁薄。所以，年轻恒牙牙髓治疗应尽力保存活髓组织，如不能保存全部活髓，也应保存根部活髓，以使牙根能正常发育。临床治疗中常选择盖髓术和活髓切断术。由于是年轻恒牙，根尖尚未发育完全，不应采用根充术（A错）。干髓术（E错）和干髓治疗（B错）仅用于治疗炎症局限于冠髓的牙髓炎，牙髓坏死和年轻恒牙和前牙不宜进行干髓治疗。根尖诱导成形术（C错）适用于牙髓病已波及根髓，而不能保留或不能全部保留根髓的年轻恒牙、牙髓全部坏死或并发根尖周炎症的年轻恒牙。